患者，男，被他人击中面颊部，伤及右侧颧部，该部位疼痛肿胀明显，颧部皮肤呈青紫色，无开口受限，X线未见骨折影像，该患者最可能的诊断为
A. 擦伤
B. 挫伤
C. 撕裂伤
D. 撕脱伤
E. 复合性损伤

正确答案：B。挫伤

解析：挫伤是皮下及深部组织遭受力的挤压损伤而无开放创口。伤处的小血管和淋巴管破裂，常有组织内渗血而形成瘀斑，甚至发生血肿。掌握“口腔颌面部软组织创伤”知识点。